慢性肺心病心衰为降低肺动脉压，减轻右心负荷，下列治疗中应选用
A. 地高辛
B. 呋塞米
C. 改善通气、吸氧
D. 异丙肾上腺素吸入
E. 可拉明静滴

正确答案：C。改善通气、吸氧

解析：对慢性肺心病出现右心衰竭的患者，一般经过氧疗、控制呼吸道感染、改善呼吸功能、纠正低氧和解除二氧化碳潴留后，心力衰竭症状可减轻或消失，患者尿量增多，水肿消退，肿大的肝缩小、压痛消失，不需常规使用利尿剂和强心剂，肺心病心力衰竭的治疗 1、应用利尿剂 2、使用正性肌力药 3、顽固性心力衰竭使用血管扩张药（AB错），故答案选择改善通气、吸氧（C对）。异丙肾上腺素（D错）对停搏的心脏具有起搏作用，使心脏恢复跳动。适用于心室自身节律缓慢，高度房室传导阻滞或窦房结功能衰竭而并发的心脏骤停，常与去甲肾上腺素或间羟胺合用作心室内注射。可拉明静滴（E错）临床上用于传染病及中枢抑制药中毒引起的呼吸抑制，也可用于长时间吸氧治疗及人工呼吸后，促进自主呼吸功能的恢复，常需间歇多次给药。